医疗卫生人员在实施接种前，应当履行下列职责，但除外
A. 告知受种者或者监护人所接种疫苗的品种、作用、禁忌、不良反应以及注意事项
B. 询问受种者的健康状况
C. 询问受种者是否有接种禁忌
D. 询问受种者家庭生活环境状况
E. 如实记录告知和询问情况

正确答案：D。询问受种者家庭生活环境状况